下列电泳法中，属于平板电泳法的是
A. 毛细管区带电泳法
B. 毛细管凝胶电泳法
C. 毛细管等速电泳法
D. 毛细管等电聚焦电泳法
E. 纸电泳法

正确答案：E。纸电泳法

解析：本题考查色谱法。平板电泳法按照支持物的不同进行的分类：①纸电泳法；②醋酸纤维素薄膜电泳法；③琼脂糖凝胶电泳法；④聚丙烯酰胺凝胶电泳法；⑤SDS-聚丙烯酰胺凝胶电泳法。